可以合并用药的情况包括
A. 提高药物的治疗效果
B. 减少药物的不良反应
C. 延缓病原菌耐药性的产生
D. 为医院获取经济利益
E. 一个病人患有多种疾病

正确答案：A、B、C、E。提高药物的治疗效果；减少药物的不良反应；延缓病原菌耐药性的产生；一个病人患有多种疾病